不论进行何种心理治疗，治疗者均应遵守以下原则，但除外
A. 真诚原则
B. 保密原则
C. 耐心原则
D. 中立与回避原则
E. 标准化原则

正确答案：E。标准化原则